延髓内的脑神经核有
A. 前庭神经核
B. 三叉神经运动核
C. 疑核
D. 展神经核
E. 面神经核

正确答案：C。疑核

解析：疑核（C对）位于延髓内；前庭神经核（A错）位于前庭区的深面；三叉神经运动核（B错）位于脑桥中部网状结构的背外侧，三叉神经脑桥核的腹内侧；展神经核（D错）位于脑桥下部，面神经丘的深面；面神经核（E错）位于脑桥下部，被盖腹外侧的网状结构内，展神经核的腹外侧。